下列哪项不是急性化脓性根尖周炎的临床表现
A. 自发性阵发性疼痛
B. 自发性持续性剧烈疼痛
C. 根尖部牙龈红肿，扪痛
D. 叩痛++～+++
E. 患牙可出现松动

正确答案：A。自发性阵发性疼痛

解析：急性化脓性根尖周炎由于牙周膜的急性炎症，患牙常松动。自觉症状疼痛很剧烈，呈持续性，搏动性痛；患牙明显伸长，不敢咬合；严重者还伴有乏力、发热、烦躁和便秘等全身症状。临床检查牙髓无活力，温度测和电测无反应；叩诊（+++）、松动Ⅲ°、相应部位牙龈扪痛（+++）。急性化脓性根尖周炎的过程经历三个阶段。其临床表现如下：
①根尖脓肿：自发持续性剧烈跳痛。叩诊（+++），松动Ⅲ°，患牙根尖部相应的唇、颊侧牙龈潮红，扪痛（+）、肿胀不明显；②骨膜下脓肿：上述症状加重，患者痛苦面容、根尖区牙龈肿胀明显、移行沟变平，扪痛并有深部波动感；区域淋巴结肿大、压痛，相应面颊部软组织呈反应性水肿；全身不适，体温升高，白细胞记数增高；③黏膜下脓肿：上述症状明显减轻，相应根尖部的牙龈肿胀局限，呈半球形隆起，扪诊波动感明显，全身症状缓解。掌握“急性根尖周炎”知识点。